重型精神病指
A. 精神分裂症
B. 躁狂抑郁型精神病
C. 其他重型精神病在发病期间
D. 偏执性精神障碍
E. 以上均是

正确答案：E。以上均是

解析：重型精神病是指精神障碍严重的精神病，导致患者自制力和日常生活能力严重受损，无法与现实社会相接触，并伴随幻觉、妄想、行为古怪、思维怪异等表现，主要包括偏执性精神障碍、躁狂抑郁型精神病、双相情感障碍、精神分裂症、其他重型精神病在发病期间等（E对ABCD错）。